女，28岁。频繁发作右下颌区剧烈疼痛3个月，呈闪电样，刀割样痛，洗脸刷牙讲话均可诱发。听力正常，面部无麻刺感，张口无困难。查体：颞颌关节无明显压痛，神经系统未见明显阳性体征。最可能的诊断是
A. 牙周炎
B. 舌咽神经痛
C. 三叉神经痛
D. 腮腺炎
E. 颞颌关节紊乱

正确答案：C。三叉神经痛

解析：青年女性患者，频繁发作右下颌区（三叉神经支配部位）剧烈疼痛3个月，呈闪电样，刀割样（三叉神经痛常见表现），洗脸刷牙讲话（三叉神经痛常见诱因）均可诱发。查体：颞颌关节无明显压痛，神经系统未见明显阳性体征。触发点为三叉神经痛的典型症状，表现为患者口角、鼻翼、颊部或舌部为敏感区，轻触可诱发以面颊上下领及舌部明显的剧烈电击样、针刺样、刀割样或撕裂样疼痛。该患者疼痛部位、性质、诱因等均符合三叉神经痛表现，综合所有症状考虑诊断为三叉神经痛（C对）。牙周炎（A错），常表现为持续性钝痛且疼痛局限于牙龈部。舌咽神经痛（B错），疼痛部位常局限于扁桃体、舌根、咽及耳道深部即舌咽神经分布区域，吞咽、讲话、呵欠常诱发。腮腺炎（D错），主要表现为一侧或两侧耳垂下肿大，肿大的腮腺常呈半球形，以耳垂为中心边缘不清，表面发热，张口或咀嚼时局部感到疼痛。在发病初期的3～5天，可有发热、乏力、食欲缺乏等全身症状。颞颌关节紊乱（E错）主要特点为颞颌关节区酸胀疼痛、运动时弹响、张口运动障碍等。患者无张口困难表现，颞颌关节也无明显压痛。